三臂卡环适用于
A. 牙冠外形好
B. 倾斜的基牙
C. 孤立的磨牙上
D. 后牙游离端缺失
E. 孤立的前磨牙上

正确答案：A。牙冠外形好

解析：三臂卡环：多用于牙冠外形好，无明显倾斜的基牙。掌握“局部义齿固位体”知识点。